下列有关伤寒肥达反应的描述，正确的是
A. 只要阳性就有明确诊断价值
B. 阴性结果即可除外伤寒
C. 可根据“O”抗体效价的不同区别副伤寒
D. “H”抗体出现较早，消失快，更有诊断
E. 检测Vi抗体可用于慢性带菌者的调查

正确答案：E。检测Vi抗体可用于慢性带菌者的调查

解析：检测Vi抗体可用于慢性带菌者的调查（E对），效价大于1:40时有诊断参考价值。结核病、结缔组织病等疾病在发热病程中也可出现肥达反应阳性，故仅肥达反应阳性不能确诊为伤寒（A错）。少数伤寒、副伤寒患者肥达反应效价始终不高或阴性，尤其以免疫应答能力低下的老年人或婴幼儿患者多见（B错）。抗体效价增高只能支持沙门菌感染，不能区别伤寒或副伤寒（C错）。“H”抗体出现迟，可持续阳性数年（D错）。